国家推进基本医疗服务实行分级诊疗制度，引导非急诊患者首先到基层医疗卫生机构就诊，实行首诊负责制和转诊审核责任制，下列哪项不是其逐步建立的机制
A. 基层首诊
B. 双向转诊
C. 专科首诊
D. 上下联动
E. 急慢分治

正确答案：C。专科首诊